吴茱萸汤中不含的药物是
A. 人参
B. 大枣
C. 吴茱萸
D. 生姜
E. 甘草

正确答案：E。甘草

解析：吴茱萸汤方含吴茱萸（C对）、人参（A对）、生姜（D对）、大枣（B对），其中，吴茱萸与生姜温胃散寒，降逆止呕；人参、大枣并用，可补脾益气，使吴茱萸与生姜所温之清阳得升，诸药共奏温中、补虚、降逆止呕之功（E错，为本题正确答案）。吴茱萸方歌—吴茱萸汤人参枣，重用生姜温胃好，阳明寒呕少阴利，厥阴头痛皆能保。